不属于CPI探针作用的是
A. 检查牙龈出血情况
B. 探测龈下牙石
C. 测牙龈沟深度
D. 检查菌斑附着厚度
E. 测牙周袋的深度

正确答案：D。检查菌斑附着厚度

解析：CPI探针的作用是：①检查牙龈出血情况，顶端小球可避免探针头部过于尖锐而刺伤牙龈组织导致出血，而误诊为牙龈炎；②探测龈下牙石；③测牙龈沟或牙周袋的深度，探针在3.5mm和5.5mm处的刻度便于测定牙周袋深度。掌握“牙周病流行病学及分级预防”知识点。